医疗机构麻醉药品处方应当至少保存
A. 1年
B. 2年
C. 3年
D. 4年
E. 5年

正确答案：C。3年

解析：本题考查麻醉药品和第一类精神药品的处方资格及处方管理。医疗机构麻醉药品处方应当至少保存3年（C对）。医疗机构应当对麻醉药品和精神药品处方进行专册登记，加强管理。麻醉药品处方至少保存3年，精神药品处方至少保存2年（B错）。